婴儿生理性贫血的时间是出生后
A. 1个月
B. 2～3个月
C. 4～6个月
D. 7～9个月
E. 10个月后

正确答案：B。2～3个月

解析：婴儿生理性贫血的时间是出生后2～3个月（B对）。生理性贫血呈自限性，无需治疗，3个月后红细胞生成素的合成增加，促进骨髓的造血功能，红细胞数和血红蛋白又会逐渐增加。